男，40岁，因呼吸困难和水肿入院。查体发现颈静脉怒张，肝在右肋缘下4cm，表面光滑，轻度压痛，双下肢压陷性水肿。该患者心音可有以下变化，除了
A. 心尖部第二心音增强
B. 心尖部第一心音增强
C. 肺动脉瓣区第二心音增强
D. 肺动脉瓣区第二心音分裂
E. 心尖部第一心音可呈拍击性

正确答案：A。心尖部第二心音增强

解析：患者中年男性，有呼吸困难和水肿症状，查体：颈静脉怒张，肝大伴压痛，双下肢压陷性水肿，考虑诊断为二尖瓣狭窄伴右心衰竭。二尖瓣狭窄时，如瓣叶柔顺有弹性，多可闻及心尖部第一心音增强（B对），呈拍击性（E对），并可闻及开瓣音。当出现肺动脉高压时，肺动脉瓣区第二心音增强（C对）并出现通常分裂（D对）。二尖瓣狭窄时心尖部可闻及第一心音增强，而不是第二心音增强（A错，为本题正确答案），第二心音一般在心底部听诊最清楚。